下列有关上颌窦癌的诊治，不正确的是
A. 上颌窦较晚才有明显的骨质破坏
B. 早期易与牙周病、根尖病、上颌窦炎混淆
C. CT片有助于早期明确诊断
D. 治疗以放射治疗为主
E. 肿瘤局限于上颌窦内无骨质破坏者，可施行上颌骨全切除术

正确答案：D。治疗以放射治疗为主

解析：上颌窦癌的早期诊断常常是治疗能否成功的关键。临床医师应有高度的警惕性，应与牙周病、根尖周病、慢性上颌窦炎等注意鉴别。上颌窦较晚才有明显的骨质破坏，早期如临床鉴别诊断困难时，可借助于曲面体层X线片、CT检查等方法明确诊断。治疗最好采用综合疗法，而以外科治疗为主。早期肿瘤局限于上颌窦内无骨质破坏者，可施行上颌骨全切除术。掌握“中央性颌骨癌及上颌窦癌”知识点。